在两个氨基酸之间新产生的（-CO-NH-）被称为
A. 离子键
B. 分子间作用力
C. 肽键
D. 碳碳双键
E. 氮氧键

正确答案：C。肽键

解析：本题考查氨基酸与多肽及蛋白质结构。在两个氨基酸之间新产生的酰胺键（-CO-NH-）称为肽键（C对）。